下列关于甲状腺激素的正确叙述是
A. 能调控生长发育
B. 使机体对儿茶酚胺类的反应降低
C. 血浆蛋白结合率低
D. 可使呆小病患者痊愈
E. 可使心率减慢

正确答案：A。能调控生长发育

解析：甲状腺激素的药理作用①维持生长发育：甲状腺激素主要促进骨骼和脑的生长发育（A对）。婴幼儿先天性甲状腺功能低下时，可使神经元轴突和树突形成障碍，神经髓鞘形成延缓，骨骺不能形成，出现身体矮小、肢体粗短、智力迟钝，即呆小病（D错）②促进代谢：甲状腺激素可促进糖、脂肪、蛋白质代谢（C错），促进物质氧化，增加耗氧量，提高基础代谢率，使产热增加。③提高交感-肾上腺系统的敏感性：甲状腺激素能使机体对交感神经递质及肾上腺髓质激素的反应性提高，故甲亢病人有情绪激动、震颤、失眠、心率加快（E错）、血压升高、神经过敏等症状。这可能与肾上腺素β受体数目增多有关（B错）。